常见的烷化剂有
A. 环磷酸胺
B. 氮芥
C. 噻替哌
D. 白消安
E. 以上都是

正确答案：E。以上都是